治疗无痰干咳宜选用的药物是
A. 克仑特罗
B. 色甘酸钠
C. 可待因
D. 氨茶碱
E. 二丙酸倍氯米松

正确答案：C。可待因

解析：本题考查可待因。可待因（C对）能选择性地抑制延髓咳嗽中枢，镇咳作用强而迅速；同时还可抑制支气管腺体的分泌，使痰液黏稠，难以咳出。适应于各种原因引起的剧烈干咳，尤其伴有胸痛的剧烈干咳。克伦特罗（A错）是选择性β₂受体激动剂，临床常用于哮喘等支气管狭窄的肺部疾病治疗。色甘酸钠（B错）为抗过敏平喘药，可抑制过敏物质及非特异性刺激引起的支气管痉挛，用于预防哮喘发作。氨茶碱（D错）为茶碱类平喘药，平喘机制主要是抑制磷酸二酯酶，使细胞内cAMP水平升高而舒张支气管，常用于急性中毒哮喘或哮喘持续状态。二丙酸倍氯米松（E错）为糖皮质激素类，通过抑制气道炎症反应，达到长期防止哮喘发作的效果。